急性胆囊炎的常见致病菌是
A. 梭状芽孢杆菌
B. 金黄色葡萄球菌
C. 溶血性链球菌
D. 铜绿假单胞菌
E. 大肠埃希菌

正确答案：E。大肠埃希菌